岁。脓毒性休克患者。动脉血气分析示代谢性酸中毒、Ⅰ型呼吸衰竭。下列治疗措施中可能造成组织缺氧加重的是
A. 静脉滴注小剂量多巴胺
B. 静脉滴注糖皮质激素
C. 补充胶体液
D. 快速补充碳酸氢钠
E. 快速补充晶体液

正确答案：D。快速补充碳酸氢钠

解析：患者青年男性，脓毒性休克患者。动脉血气分析示代谢性酸中毒、Ⅰ型呼吸衰竭。对于该患者，正确的治疗方案包括补充血容量，首先以输注平衡盐溶液为主（E对），配合适当的胶体液（C对）、血浆或全血，恢复足够的循环血量；控制感染；纠正酸碱平衡；心血管活性药物的应用，例如山莨菪碱、多巴胺（A对）等；糖皮质激素（B对）及营养支持和对并发的DIC、重要器官功能障碍的处理。快速补充碳酸氢钠（D错，为本题正确答案）使血红蛋白氧离曲线左移，氧不易从血红蛋白释出，可使组织缺氧加重。